分布于拇指的皮肤是
A. 正中神经
B. 尺神经
C. 正中神经和尺神经
D. 正中神经和桡神经
E. 舌下神经

正确答案：D。正中神经和桡神经

解析：正中神经的感觉纤维则分布于桡侧半手掌、桡侧三个半手指掌面皮肤及其中节和远节指背皮肤。桡神经的浅支分布于手背桡侧半皮肤和桡侧两个半手指近节背面的皮肤（D对）。尺神经（BC错）的浅支分布于小鱼际表面的皮肤、小指掌面皮肤和环指尺侧半掌面皮肤。舌下神经（E错）支配舌内肌和大部分舌外肌。